外伤性腹膜后巨大血肿易发生
A. 麻痹性肠梗阻
B. 单纯性肠梗阻
C. 痉挛性肠梗阻
D. 绞窄性肠梗阻
E. 机械性肠梗阻

正确答案：A。麻痹性肠梗阻

解析：腹膜后血肿因出血程度和范围各异，临床表现并不恒定，并常因有合并损伤而被掩盖。一般说来，除部分伤者可有髂腰部瘀斑（Grey-Turner征）外，突出的表现是内出血征象、腰背痛和肠麻痹（A对）；伴尿路损伤者则常有血尿。